关于基底细胞腺瘤的预后，下列说法正确的是
A. 恶性肿瘤，区域切除后很少复发
B. 良性肿瘤，区域切除后很少复发
C. 良性肿瘤，区域切除后常常复发
D. 恶性肿瘤，区域切除后常见复发
E. 良性脓肿，区域切除后很少复发

正确答案：B。良性肿瘤，区域切除后很少复发

解析：本题考查基底细胞腺瘤的生物学行为。关于基底细胞腺瘤的预后，说法正确的是恶性肿瘤，区域切除后很少复发（B对）。基底细胞腺瘤是一种良性肿瘤（AD错），它以基底细胞样形态的肿瘤细胞为特征，缺乏多形性腺瘤中的黏液软骨样成分，大多数发生于腮腺，多见于60～70岁，男女之比为1:2，基底细胞腺瘤为良性肿瘤，区域切除后很少复发（CE错），来源于闰管或闰管储备细胞,其病理分型主要有：1.实性型：肿瘤细胞排列成不同大小和形态的片状或岛状结构；2.小梁型：肿瘤性基底样细胞排列成小梁或条索状结构；3.膜性型：肿瘤细胞岛周围基底膜明显；4.管状型：肿瘤细胞排列成管状结构。